治疗消渴中消证，应首选
A. 六味地黄丸
B. 玉女煎
C. 左归丸
D. 沙参麦冬汤
E. 麦门冬汤

正确答案：B。玉女煎

解析：根据五版教材，中消的病机是胃火内炽，胃热消谷，耗伤津液，治疗应清胃泻火，养阴增液。玉女煎清胃滋阴，最宜治疗中消。（七版教材中消除胃热炽盛外还有气阴亏虚）（B对）。六味地黄丸，其功用为滋补肝肾，可用于下消之肾阴亏虚证(A错)。左归丸，其功用为滋阴补肾，填精益髓，适用于真阴不足证（C错）。沙参麦冬汤，其功用为甘寒养阴，润燥生津，可用于内伤咳嗽之肺阴亏虚证或虚劳之肺阴虚证（D错）。麦门冬汤，其功用为滋阴养胃，降逆止呕，可用于呕吐之胃阴不足证（E错）。